唾液腺造影的禁忌证是
A. 肿瘤
B. 慢性炎症
C. 涎瘘
D. 急性化脓性腮腺炎
E. 口干

正确答案：D。急性化脓性腮腺炎

解析：唾液腺造影术禁忌证：对碘过敏者；唾液腺急性炎症期间；唾液腺导管阳性结石，以避免注射造影剂时将结石向后推移。掌握“唾液腺造影技术、CT及MRI”知识点。